以下是关于传统式健康教育方法和参与式健康教育方法的说法，存在错误的一项是
A. “传统式”并不意味著该方式陈旧而应淘汰
B. 传统式健康教育的方法有参与式健康教有无法取代的作用
C. 传统式以教师为主导
D. 参与式健康教育方法中，教师起组织、协调的作用，学生参与程度高
E. 参与式教育方法有很多优点，没有弱点

正确答案：E。参与式教育方法有很多优点，没有弱点